男性，15岁。突发心窝处阵发性钻顶样疼痛6小时，疼痛时大汗淋漓，辗转不安，痛止时又平息如常。体检：剑突偏右方可有深在压痛，无腹肌紧张及反跳痛。为明确诊断应采取简单安全的方法
A. B超检查
B. 右上腹X线平片
C. 测定血清淀粉酶
D. 十二指肠引流检查
E. ERCP

正确答案：A。B超检查

解析：患者心窝处阵发性钻顶样疼痛（胆道蛔虫病典型表现），痛时辗转不安、间歇如常，剑突偏右方深在压痛，根据临床表现及查体，考虑胆道蛔虫症。B超对胆道疾病显影清楚，诊断准确率高，可确诊胆道蛔虫病，且操作简单、价格低廉，为确诊疾病，应选择B超检查（A对）。右上腹X线平片（B错）对蛔虫不显影；测定血清淀粉酶（C错）主要用于胰腺炎诊断；十二指肠引流检查（D错）对于胆石症、慢性胆囊炎、十二指肠炎有一定提示意义，以上检查对胆道蛔虫病诊断意义不大。ERCP（E错）为有创检查，一般不作首选。